关于月经调节的说法，下列说法正确的是
A. 月经周期的调节主要涉及下丘脑、垂体和卵巢
B. 下丘脑分泌促性腺激素释放激素，调节垂体释放促性腺激素
C. 卵巢分泌性激素对下丘脑-垂体具有反馈调节作用
D. 下丘脑、垂体与卵巢形成下丘脑-垂体-卵巢轴
E. 以上均正确

正确答案：E。以上均正确

解析：月经周期的调节主要涉及下丘脑、垂体和卵巢。下丘脑分泌促性腺激素释放激素，调节垂体促性腺激素释放，调控卵巢功能。卵巢分泌性激素对下丘脑-垂体具有反馈调节作用。下丘脑、垂体与卵巢间相互调节、相互影响，形成完整、协调的神经内分泌系统，称为下丘脑-垂体-卵巢轴。下丘脑生殖调节激素由神经细胞分泌，下丘脑-垂体-卵巢轴的调节属于神经内分泌调节。掌握“女性生殖系统生理”知识点。